下列不属于躯体因素对儿童心理健康影响的是
A. 慢性疾病的损伤
B. 电击
C. 噪音
D. 火灾
E. 高温

正确答案：D。火灾

解析：本题考查躯体因素对儿童心理健康影响。火灾（D错，为本题正确答案）属于社会因素。躯体因素是指对儿童身体直接产生损害的因素，例如急慢性疾病的损伤（A对）、创伤、电击（B对）、噪音（C对）、高温（E对）等，这些因素会使儿童产生心理行为问题。